患者，女，56岁。右下肢静脉迂曲扩张20年，伴下肢酸胀，水肿，活动或抬高患肢减轻，近2年右足靴区皮肤发红，时有瘙痒，逐渐加重，查体右下肢大腿内侧、小腿后可见迂曲扩张静脉团，足靴区色素沉着，皮肤变厚。为明确手术治疗方法，术前必须进行哪项检查
A. 下肢皮温测定
B. 下肢静脉压测定
C. 下肢多普勒超声检查
D. 右下肢静脉造影
E. 深静脉瓣功能试验

正确答案：D。右下肢静脉造影

解析：患者为中老年女性，右下肢静脉迂曲扩张20年，可见迂曲扩张静脉团，伴下肢酸胀、水肿，活动或抬高患肢减轻。后右足靴区出现皮肤营养性变化（发红、瘙痒，色素沉着，皮肤变厚）。根据患者的症状和体征可初步诊断为下肢慢性静脉功能不全。下肢慢性静脉功能不全主要包括“单纯性下肢静脉曲张”与“下肢深静脉瓣膜功能不全”，均可表现为下肢静脉迂曲扩张、下肢水肿、酸胀，活动后缓解，足靴区营养障碍性变化。单纯性下肢静脉曲张可采取高位结扎大隐静脉的术式，而深静脉瓣功能不全需实施深静脉瓣膜重建术。现为明确手术治疗方法，术前必须进行右下肢静脉造影（D对），清晰直观的观察下肢深静脉瓣膜的功能状况。下肢皮温测定（A错）为动脉疾病常见的检查方法；下肢静脉压测定（B错）、深静脉瓣功能试验（E错）只能间接了解瓣膜功能，只作为筛选性检查；下肢多普勒超声检查（C错）可以观察瓣膜关闭活动及有无逆向血流，但不如静脉造影直观。